维生素K的作用是
A. 抑制血小板聚集
B. 促进四氢叶酸类辅酶的循环利用
C. 抑制纤溶酶
D. 促进纤溶
E. 阻止凝血因子合成

正确答案：C。抑制纤溶酶

解析：本题考查维生素K的作用。维生素K的作用是抑制纤溶酶（C对）。维生素K拮抗剂可抑制维生素K在形成凝血因子过程中的作用从而抑制凝血因子的合成（E错）。阿司匹林能够抑制血小板聚集（A错）。维生素B₁₂参与核酸和蛋白质的合成，具有促进四氢叶酸类辅酶循环利用（B错）的作用。临床上具有促进纤溶作用（D错）的药物多为溶栓药如链激酶、尿激酶等。